混牙（牙合）的年龄段是
A. 胚胎至出生
B. 出生至6岁
C. 6岁至12岁
D. 出生至12岁
E. 胚胎至12岁

正确答案：C。6岁至12岁

解析：混牙（牙合）特征：约在6岁时，第一恒磨牙萌出，即为替牙期的开始。约至12岁时，乳牙全部为恒牙所替换，即为替牙期的结束。故从6～12岁，皆属混牙（牙合）。掌握“（牙合）的生长发育”知识点。